下列哪一项属于颌面骨结核的感染来源
A. 可因体内其他脏器结核病沿血行播散所致
B. 开放性肺结核可经口腔黏膜感染
C. 可以是口腔黏膜及牙龈结核直接累及颌骨
D. 开放性肺结核可经牙龈创口感染
E. 以上都可以是颌面骨结核的感染来源

正确答案：E。以上都可以是颌面骨结核的感染来源

解析：颌面骨结核感染来源：感染途径可因体内其他脏器结核病沿血行播散所致；开放性肺结核可经口腔黏膜或牙龈创口感染；也可以是口腔黏膜及牙龈结核直接累及颌骨。掌握“颌面部骨结核、放线菌病”知识点。